对各种原因引起的牙的错位修复前应进行
A. 拔除
B. 正畸治疗
C. 牙槽骨成形术
D. 临床牙冠延长
E. 咬合调整与选磨

正确答案：B。正畸治疗

解析：本题考查修复前准备。修复前的正畸治疗（B对）：对各种原因引起的牙的错位（扭转牙、低位牙等），尤其是牙缺失后长期未曾修复造成的缺隙两侧牙倾斜移位。